下列面神经走向的描述哪项是错误的
A. 穿内耳道底入面神经管
B. 经茎乳孔出颅
C. 在面神经管内无分支
D. 以茎乳孔为界分为面神经管段和颅外段
E. 穿腮腺后内侧面，终支分布于面部表情肌

正确答案：C。在面神经管内无分支

解析：本题考查面神经。面神经管内分为岩大神经、镫骨肌神经、鼓索（C错，为本题的正确答案）三支。面神经于脑桥延髓沟的外侧部出脑后入内耳门，穿内耳道底入面神经管（A对），经茎乳孔出颅（B对），以茎乳孔为界，将面神经分为面神经管段和颅外段（D对），穿腮腺后内侧面，分为颞支、颧支、颊支、下颌缘支、颈支五支，分布于面部表情肌（E对）。